男，15岁。咽痛，发热1周，双下肢对称性紫癜伴腹痛及关节痛3天。实验室检查：血Hb125g/L，WBC10.5×10⁹/L，Plt110×10⁹/L，凝血时间正常，粪隐血（+）。该患者最有可能出现异常结果的检查是
A. 活化部分凝血活酶时间
B. 骨髓细胞染色体检查
C. 血小板聚集功能
D. 骨髓细胞学检查
E. 毛细血管脆性试验

正确答案：E。毛细血管脆性试验

解析：青少年男性，咽痛、发热（感染史），双下肢对称性紫癜、腹痛、关节痛，粪隐血（+）。最可能的诊断是过敏性紫癜。该患者最有可能出现异常结果的检查是毛细血管脆性试验（E对）。过敏性紫癜血小板功能及凝血相关检查：除出血时间(BT）可能延长外，其他均正常（AC错）。